下列何种降血糖药易引起乳酸血症
A. 正规胰岛素
B. 阿卡波糖
C. 格列本脲
D. 甲苯磺丁脲
E. 苯乙双胍

正确答案：E。苯乙双胍